某植物提取物遇皮肤呈蓝色，可能含有
A. 蒽醌
B. 鞣质
C. 环烯醚萜
D. 生物碱
E. 强心苷

正确答案：C。环烯醚萜